关于桩核冠桩的直径，正确的是
A. 根径的1/2
B. 根径的1/3
C. 上前牙为2.5～2.8mm
D. 下前牙为0.8～1mm
E. 后牙为1.1～1.5mm

正确答案：B。根径的1/3

解析：本题考查桩核冠的设计。桩核冠桩的直径为根径的1/3（B对）。桩的直径对桩的固位与抗力都有影响。一般要求桩的直径在1/4～1/3根径范围内。桩的直径大，桩与根管内壁的接触面积越大，固位及抗力性也就越好；但桩越粗根管壁越薄，易导致受力时牙根折断；而桩过细，则受力时易产生桩的弯曲或折断。